斑蝥有毒，为降低其毒性，宜采用的炮制方法是
A. 土炒
B. 砂炒
C. 蛤粉炒
D. 米炒
E. 滑石粉炒

正确答案：D。米炒

解析：本题考查的是斑蝥的炮制方法。斑蝥有毒，为降低其毒性，宜采用的炮制方法是米炒（D对）。米炒是将净制或切制后的药物与米同炒的方法。米炒的目的：①增强药物的健脾止泻作用，如党参。②降低药物的毒性，如红娘子、斑蝥。③矫正不良气味，如昆虫类药物。土炒（A错）是将净选或切制后的药物与灶心土（伏龙肝）拌抄的方法。土炒的目的：灶心土味辛性温，能温中燥湿，止呕，止泻。常用来炮制补脾止泻的药物。如白术、山药等。砂炒（B错）法，亦称砂烫法，是将净选或切制后的药物与热砂共同拌炒的方法。砂炒的目的：①增强疗效，便于调剂和制剂，如狗脊、穿山甲等。②降低毒性，如马钱子等。③便于去毛，如骨碎补等。④矫臭矫味，如鸡内金、脐带等。蛤粉炒（C错），又称蛤粉烫，是将净制或切制后的药物与蛤粉共同拌炒的方法。蛤粉炒的目的：①使药物质地酥脆，便于制剂和调剂。②降低药物的滋腻之性，矫正不良气味。如阿胶、鹿角胶等。滑石粉炒（E错），又称滑石粉烫，是将净制或切制后的药物与滑石粉共同拌炒的方法。滑石粉炒的目的：①使药物质地酥脆，便于粉碎和煎煮，如黄狗肾等。②降低毒性及矫正不良气味，如刺猬皮、水蛭等。